粘接固定桥
A. 可以自行摘戴的固定桥
B. 被称为完全固定桥
C. 固位力主要来自粘接材料的粘结力的固定桥
D. 一端的固定体为固定连接，另一端的固位体为活动连接的固定桥
E. 以各种骨内种植体作为固定桥的支持和固位端制成的固定桥

正确答案：C。固位力主要来自粘接材料的粘结力的固定桥

解析：粘接固定桥：是利用酸蚀、粘接技术将固定桥直接粘固于基牙上，修复牙列缺损。其固位主要依靠粘接材料的粘结力，而牙体预备的固位形起辅助固位作用。粘接固定桥与传统固定桥相比，牙体预备时磨削牙体组织少，减少牙髓损伤。掌握“固定桥的组成和分类”知识点。